亚硝酸钠滴定法中加入适量溴化钾的作用是
A. 防止重氮盐分解
B. 防止亚硝酸遗失
C. 延缓反应
D. 加速反应
E. 使终点清晰

正确答案：D。加速反应